张某，在某医疗机构进行身体检查时被查出患有血吸虫病，依据《传染病防治法》的规定，对于张某该医疗机构应当
A. 强制隔离治疗
B. 在指定的场所进行医学观察
C. 采取必要的治疗和控制措施
D. 采取必要的预防和控制措施
E. 在指定场所进行隔离治疗

正确答案：C。采取必要的治疗和控制措施